对习惯性便秘者慎用的药品是
A. 谷维素
B. 色甘酸钠
C. 羧甲司坦
D. 氢溴酸东莨菪碱
E. 硫糖铝

正确答案：E。硫糖铝

解析：本题考查硫糖铝。对习惯性便秘者慎用的药品是硫糖铝（E对）。硫糖铝用于预防上消化道出血。长期用药可致便秘，偶有恶心、胃部不适、腹泻、皮疹、瘙痒及头晕。禁忌证：习惯性便秘者，肾功能不全者，不宜长服。谷维素（A错）禁用于过敏体质、消化道溃疡患者。色甘酸钠（B错）禁用于对色甘酸钠过敏者。对吸入拟肾上腺素药敏感者及孕妇慎用。羧甲司坦（C错）禁用于消化道溃疡处于活动期的患者。氢溴酸东莨菪碱（D错）禁用于对本品有过敏史者、严重心脏病、器质性幽门狭窄、麻痹性肠梗阻、青光眼、前列腺增生患者。